一男性青年，突发高热，黄疽伴肝区痛，厌油，实验室检查ALT升高，抗HAV阳性，印象诊断为急性黄疽性肝炎。该病主要的传播方式是
A. 呼吸道传播
B. 消化道传播
C. 泌尿道传播
D. 经虫媒传播
E. 经输血传播

正确答案：B。消化道传播